关于上消化道出血的定义，正确的是
A. 贲门以上部位出血
B. 幽门以上部位出血
C. 空肠以上部位出血
D. Treitz韧带以上部位出血
E. 十二指肠乳头水平以上部位出血

正确答案：D。Treitz韧带以上部位出血

解析：消化道是指从食管到肛门之间组织，分为上、中、下三个部分。其中，上消化道出血是指Treitz韧带以上部位出血（D对）；中消化道出血是指Treitz韧带至回盲部之间出血；下消化道出血是指回盲部以远的消化道出血。